食物易滞留的部位
A. 咽后壁
B. 软腭黏膜
C. 扁桃体窝
D. 梨状隐窝
E. 咽隐窝

正确答案：D。梨状隐窝

解析：食物易滞留的部位是梨状隐窝（D对）。